下列关于药物不良反应叙述错误的是
A. 治疗量时出现的与治疗目的无关的反应
B. 难以避免，停药后可恢复
C. 常因剂量过大引起
D. 常因药物作用选择性低引起
E. 副作用与治疗目的是相对的

正确答案：C。常因剂量过大引起

解析：药物副作用属于药物不良反应，指药物在治疗剂量时（C错，为本题正确答案）与治疗作用同时发生的与治疗目的的无关的作用（A对），药物的副作用常因药物选择性低引起（D对），如阿托品用于解除胃肠痉挛时，可引起口干、心悸、便秘等反应。副作用一般比较轻微，难以避免，多在停药后即可自行恢复（B对）。副作用与治疗目的是相对的（E对），副作用可以随治疗目的不同而改变，将药物的某一作用作为治疗作用时，其他的作用成为副作用，如阿托品有抑制腺体分泌的作用，引起口干和皮肤干燥，可用作麻醉前给药，防止分泌物阻塞呼吸道而引起窒息或吸入性肺炎，但阿托品用于缓慢性心律失常，休克治疗等时，抑制腺体分泌的作用会引起口干、便秘等副作用。